属于医疗用毒性药品的是
A. 胰岛素注射液
B. 亚砷酸注射液
C. 罗哌卡因注射液
D. 高锰酸钾粉
E. 氯化钾注射液

正确答案：B。亚砷酸注射液

解析：本题考查医疗用毒性药品的定义。亚砷酸注射液（B对）主要成分为三氧化二砷。医疗用毒性药品指毒性剧烈、治疗剂量与中毒剂量相近,使用不当会致人中毒或死亡的药品，其中三氧化二砷为毒性西药。